拔牙创的处理，错误的是
A. 刮除拔牙创内的碎牙片、牙石和肉芽组织
B. 与骨膜、牙龈相连的骨折片应予复位
C. 拔牙创常规用生理盐水彻底冲洗
D. 扩大的牙槽窝要压迫复位
E. 复位、缝合撕裂的牙龈

正确答案：C。拔牙创常规用生理盐水彻底冲洗

解析：本题考查拔牙创的处理。拔牙创不应用生理盐水（C错，为本题的正确答案）冲洗以免冲走血凝块，造成拔牙窝出血。牙拔除后，应首先检查牙根是否完整、数目是否符合该牙的解剖规律。然后检查牙龈有无撕裂，明显撕裂者复位、缝合撕裂的牙龈（E对），避免术后出血。用刮匙探查拔牙窝，去除异物（牙石、牙片、骨片）、炎性肉芽组织（A对）、根端小囊肿等。检查牙槽骨有无折断，折断骨片大部有骨膜附着者应予复位（B对）。扩大的牙槽窝妨碍创口愈合，并可能影响义齿修复，应予压破复位（D对）。